治疗癌痛患者因服用阿片类镇痛剂导致的便秘，宜选择的药物是
A. 比沙可啶
B. 乳果糖
C. 硫酸镁
D. 东莨菪碱
E. 阿托品

正确答案：B。乳果糖

解析：本题考查乳果糖。治疗癌痛患者因服用阿片类镇痛剂导致的便秘，宜选择的药物是乳果糖（B对）。乳果糖是一种渗透性泻药，因为无肠道刺激性，可用于治疗慢性功能性便秘。使用阿片类镇痛药的癌症患者对比沙可啶（A错）的耐受性差，可能会造成腹痛、腹泻和大便失禁。硫酸镁（C错）为容积性泻药，其作用强烈，排出大量水样便。东莨菪碱（D错）为颠茄中药理作用最强的一种生物碱，可用于阻断副交感神经，也可用作中枢神经系统抑制剂。他的作用类似颠茄碱，但作用较强且较短暂。临床用的一般是他的氢溴酸盐，可用于麻醉镇痛、止咳、平喘，对动晕症有效，也可用于控制帕金森病的僵硬和震颤。阿托品（E错）主要用来解除平滑肌痉挛、缓解内脏绞痛、改善循环和抑制腺体分泌，并扩大瞳孔，升高眼压，兴奋呼吸中枢。